根龋多见于
A. 儿童
B. 婴幼儿
C. 成人
D. 老年人
E. 以上均正确

正确答案：D。老年人

解析：根龋：根龋，也称根面龋。多见于中老年人和牙周病患者。龋损部位多围绕牙颈部，可有龋洞，也常见牙根表面广泛的浅表损害。掌握“龋病的临床表现与分类”知识点。